中度缺氧缺血性脑病的临床表现是
A. 出生24h内症状最明显
B. 淡漠与激惹交替
C. 肌张力增加
D. 瞳孔扩大
E. 出现惊厥，肌阵挛

正确答案：E。出现惊厥，肌阵挛

解析：中度缺血缺氧性脑病临床上常表现为小儿嗜睡、反射减弱、肌张力减低、可出现惊厥和肌阵挛（E对），存在呼吸活动不规则但不明显。淡漠与激惹交替（B错），肌张力增加（C错），瞳孔扩大（D错）均是轻度缺氧缺血性脑病的临床表现。通常情况下，缺氧缺血性脑病造成的脑部急性损伤，24小时内会出现症状，但在24～72h最明显，而非出生24小时内症状最明显（A错）。